患者肝中维生素K环氧化物还原酶发生变异，与香豆素类药物的亲和力降低，需要5～20倍的常规剂量的香豆素类药物才能起到抗凝作用，这种个体差异属于
A. 高敏性
B. 低敏性
C. 变态反应
D. 增敏反应
E. 脱敏作用

正确答案：B。低敏性

解析：本题考查影响药物的作用因素。患者肝中维生素K环氧化物还原酶发生变异，与香豆素类药物的亲和力降低，需要5～20倍的常规剂量的香豆素类药物才能起到抗凝作用，这种个体差异属于低敏性（B对）。高敏性（A错）是某些个体对药物剂量反应非常敏感，在低于常用量下药物就会产生非常强烈的作用。变态反应（C错）亦称过敏反应，指机体受药物刺激，发生异常的免疫反应，而引起生理功能障碍或组织损伤。增敏反应（D错）指某药可使组织或受体对另一药的敏感性增强。脱敏作用（E错）指某药可使组织或受体对另一药物的敏感性减弱。。